颌骨骨髓炎X线呈“虫蚀状”低密度区的病理基础是
A. 骨膜增生，骨膜加厚
B. 骨组织增生，骨小梁增粗
C. 骨组织吸收，骨小梁结构不清
D. 死骨形成，肉芽组织充填
E. 新骨形成，骨小梁不规则

正确答案：C。骨组织吸收，骨小梁结构不清

解析：颌骨骨髓炎X线呈“虫蚀状”低密度区的病理基础：主要病理表现为伴有明显骨吸收和死骨形成的化脓性病灶，死骨主要表现为骨细胞消失，骨陷窝空虚，骨小梁周围缺乏成骨细胞，骨小梁结构不清。掌握“急慢性化脓性颌骨骨髓炎”知识点。